绒毛膜癌时主要增高的是
A. 血淀粉酶检测
B. 血清甲胎蛋白检测
C. 腹部CT检查
D. 血CEA
E. 绒毛膜激素

正确答案：E。绒毛膜激素

解析：绒毛膜促性腺激素是由胎盘的滋养层细胞分泌的一种糖蛋白，升高主要见于妊娠或者滋养细胞肿瘤。绒毛膜癌时主要增高的是绒毛膜促性腺激素（E对）。血淀粉酶检测（A错）主要用于急性胰腺炎的诊断和急腹症的鉴别诊断。血清甲胎蛋白检测（B错）是诊断原发性肝癌的特异性肿瘤标志物。甲胎蛋白增高也可见于某些生殖腺胚胎肿瘤如睾丸癌、卵巢癌、畸胎瘤等，而与绒毛膜癌关系不大。血CEA（D错）（癌胚抗原）升高主要见于胰腺癌、结肠癌、直肠癌、乳腺癌、胃癌、肺癌等患者。